执业药师对护士的用药咨询是
A. 药品的鉴定方法
B. 药品的验收程序
C. 药品的使用方法
D. 药品的一般贮存条件
E. 药品生产企业详细地址

正确答案：C。药品的使用方法

解析：本题考查的是护士的用药咨询。执业药师对护士的用药咨询是药品的使用方法（C对）。护士用药咨询：由于护理的工作特点决定了他们需要更多地获得有关药物的配伍、配伍禁忌、剂量、用法，注射剂配置溶媒、浓度和输液滴注速度，以及输液药物的稳定性和配伍的理化变化、药品的保管等信息。药品的鉴定（A错）、贮存（D错）为患者用药咨询。患者咨询的内容一般可分为以下情况：（1）药品名称：包括通用名、商品名、别名。（2）适应病证：药品适应病证与患者病情相对应。（3）用药禁忌：包括配伍禁忌、妊娠禁忌、证候禁忌、饮食禁忌等。（4）用药方法：包括口服药品的正确服用方法、服用时间和用药前的特殊提示；栓剂、滴眼剂、气雾剂等外用剂型的正确使用方法；缓释制剂、控释制剂、肠溶制剂等特殊剂型的用法；如何避免漏服药物，以及漏服后的补救办法。（5）用药剂量：包括首次剂量、维持剂量；每日用药次数、间隔；疗程。（6）服药后预计疗效及起效时间、维持时间。（7）药品的不良反应与药物相互作用。（8）有否替代药物或其他疗法。（9）药品的鉴定辨识、贮存和有效期。（10）药品价格、报销，是否进入医疗保险报销目录等。药品的验收程序（B错）、药品生产企业详细地址（E错），不属于用药咨询服务的范畴。